构成釉质的基本结构是
A. 釉柱
B. 釉梭
C. 釉板
D. 牙本质小管
E. 釉丛

正确答案：A。釉柱

解析：釉质的基本结构是釉柱。掌握“牙釉质”知识点。